因对心脏快速延迟整流钾离子通道（hERGK⁺通道）具有抑制作用，可引起Q-T间期延长，甚至诱发尖端扭转型室性心动过速，现已撤出市场的药物是
A. 卡托普利
B. 莫沙必利
C. 赖诺普利
D. 伊托必利
E. 西沙必利

正确答案：E。西沙必利

解析：本题考查西沙比利的副作用。西沙必利（E对）具有心脏副作用，可导致Q-T间期延长、晕厥、室性心律不齐。卡托普利（A错）和赖诺普利（C错）为血管紧张素转化酶抑制剂，适用于患有充血性心力衰竭，左心室功能紊乱或糖尿病的高血压患者。莫沙必利（B错）为新型胃动力药物，无心脏副作用，无导致Q-T间期延长和室性心律失常作用。伊托必利（D错）是一种具有阻断多巴胺D₂受体活性和抑制乙酰胆碱酶活性的促胃肠动力药物，其在中枢神经系统分布少，无致室性心律失常作用及其它严重药物不良反应，不易导致Q-T间期延长和室性心律失常，适用于功能性消化不良引起的各种症状。